含有儿茶酚胺结构的肾上腺素，在体内发生COMT失活代谢反应是
A. 甲基化结合反应
B. 与硫酸的结合反应
C. 与谷胱甘肽的结合反应
D. 与葡萄糖醛酸的结合反应
E. 与氨基酸的结合反应

正确答案：A。甲基化结合反应

解析：本题考查药物化学结构与第Ⅱ相生物转化的规律。含有儿茶酚胺结构的肾上腺素，在体内发生COMT失活代谢反应是甲基化结合反应（A对）。第Ⅱ相生物转化反应包括：1.与葡萄糖醛酸的结合反应、2.与硫酸的结合反应、3.与氨基酸的结合反应、4.与谷胱甘肽的结合反应、5.乙酰化结合反应、6.甲基化结合反应。酚羟基的甲基化反应主要对象是具有儿茶酚胺结构的活性物质，如肾上腺素，肾上腺素经儿茶酚-氧-甲基转移酶（COMT）快速甲基化后生成3-O-甲基肾上腺素；与硫酸的结合反应（B错）是药物分子与硫酸结合，如支气管扩张药沙丁胺醇，与硫酸结合形成硫酸酯化结合物；与谷胱甘肽的结合反应（C错）是药物分子与谷胱甘肽结合，如白消安；与葡萄糖醛酸的结合反应（D错）是药物分子与葡萄糖醛酸结合，如对乙酰氨基酚；与氨基酸的结合反应（E错）羧酸类药物和代谢物的结合，如苯甲酸和水杨酸参与结合反应后生成马尿酸和水杨酰甘氨酸。